初产妇，妊娠37周，8小时前突然出现阴道流液，如尿样，6小时前开始出现规律宫缩，因胎手脱出于阴道口2小时就诊，查体：产妇烦躁不安，腹痛拒按，脉搏110次/分，呼吸28次/分，胎心160次/分，导尿时血尿。最适宜的处理是
A. 口服地西泮
B. 消毒后还纳肢体
C. 全麻下行内倒转术
D. 立即行剖宫产
E. 等待宫口开全后行牵引术

正确答案：D。立即行剖宫产

解析：该初产妇，妊娠37周（为足月产）。胎膜破，出现规律宫缩，因胎手脱出于阴道口2小时就诊（为肩难产征象，说明该患者存在梗阻性难产因素）。查体：产妇烦躁不安，腹痛拒按（先兆早产的产妇出现烦躁不安，呼吸、心率加快，下腹剧痛难忍），脉搏110次/分（＞100次/分，为心动过速），呼吸28次/分（＞24次/分，呼吸加快），胎心160次/分（胎心率在正常范围），导尿时血尿（排膀胱受压充血，出现尿困难及血尿），诊断首先考虑先兆子宫破裂。最适宜的措施是：应立即抑制子宫收缩，肌内注射哌替啶（A错），或静脉全身麻醉；立即行剖宫产术（D对）。不能采取消毒后还纳肢体（B错）、全麻下行内倒转术（C错）、等待宫口开全后行牵引术（E错）等措施，否则会耽搁最佳手术时机，危及母儿生命安全。